患者，男性，67岁，患牙左下6因重度磨耗露髓，拟行根管治疗，常规根管治疗的步骤为
A. 根管清理、预备和充填
B. 根管封药和充填
C. 根管清理和充填
D. 根管预备、消毒和充填
E. 根管清理、封药和充填

正确答案：D。根管预备、消毒和充填

解析：对患牙施行根管治疗时，一般遵循根管预备，根管消毒与根管充填三个步骤进行。掌握“根管治疗术概述”知识点。